若深龋备洞达到牙本质，则牙本质切割面渗出的牙本质液的成分与下列哪项体液相似
A. 细胞液
B. 血小板
C. 血浆
D. 胆固醇
E. 胆汁

正确答案：C。血浆

解析：牙本质液可通过牙本质小管自牙髓达到釉牙本质界。在釉质损伤时一些液体也可在釉牙本质界达到牙髓。牙本质切割面的液体成分与血浆相似，实际上是血浆的渗出物。掌握“牙本质”知识点。